不属于气机失调的病机是
A. 气滞
B. 气虚
C. 气闭
D. 气陷
E. 气逆

正确答案：B。气虚

解析：气的升降出入运动失常称为气机失调，由于气的运动形式是多种多样的，所以气机失调也有多种表现。例如：气的运动受阻而不畅通，称作气机不畅，受阻较甚，局部阻滞不通，称作气滞（A对）。气的上升太过或下降不及，称作气逆（E对）。气的上升不及或下降太过，称作气陷（D对）。气的外出太过而不能内守，称作气脱；气不能外达而郁结闭塞于内，称作气闭（C对）。气虚，是气不足，不属于气机失调（B错，为本题正确答案）。